控制间日疟发作的首选药物是
A. 吡喹酮
B. 氯喹
C. 乙胺嘧啶
D. 伯氨喹
E. 奎宁

正确答案：B。氯喹

解析：控制间日疟发作的首选药物是氯喹（B对），该药对各种疟原虫的红细胞内期裂殖体均有较强的杀灭作用，能迅速有效地控制疟疾的临床发作。奎宁（E错）的抗疟作用与氯喹相似，但不良反应较氯喹多，故不宜作为首选药物。伯氨喹（D错）主要用于控制复发和传播。乙胺嘧啶（C对）常用于疟疾病因性预防。吡喹酮（A错）主要用于治疗血吸虫病。